我国重点监测的性传播疾病不包括
A. 淋病
B. 生殖器疱疹
C. 梅毒
D. 阴道念珠菌病
E. 尖锐湿疣

正确答案：D。阴道念珠菌病

解析：我国重点监测的性传播疾病包括：梅毒（C对）、淋病（A对）、非淋菌性尿道（宫颈）炎、尖锐湿疣（E对）、生殖器疱疹（B对）、软下疳、性病性淋巴肉芽肿和艾滋病八种疾病。阴道念珠菌病是由假丝酵母菌引起的外阴阴道炎症，主要为内源性传染，仅有少部分患者通过性交直接传染（D错，为本题正确答案）。